仅对革兰阴性杆菌有强效，对革兰阳性菌、厌氧菌稍差的药物是
A. 氨苄西林
B. 头孢唑林
C. 亚胺培南
D. 青霉素
E. 氨曲南

正确答案：E。氨曲南

解析：本题考查氨曲南。氨曲南（E对）对需氧革兰阴性菌有效，对革兰阳性菌和厌氧菌作用差，属于窄谱抗菌药。氨苄西林（A错）对青霉素敏感的革兰氏阳性菌以及部分革兰氏阴性杆菌有效。头孢唑林（B错）主要作用于需氧革兰阳性球菌和少数肠杆菌科细菌。亚胺培南（C错）是抗菌谱最广的β-内酰胺类药物，对革兰阳性菌、革兰阴性菌、需氧菌、厌氧菌均有很强的抗菌活性。青霉素（D错）主要是抗革兰氏阳性菌，对革兰氏阴性杆菌作用较弱。